安息香性平，辛散苦泄，芳香走窜，其主治病证不包括
A. 湿阻痞满
B. 心腹疼痛
C. 闭证神昏
D. 痹痛日久
E. 产后血晕

正确答案：A。湿阻痞满

解析：本题考查安息香的主治病证。安息香性平，辛散苦泄，芳香走窜，其主治病证不包括湿阻痞满（A错，为本题正确答案）。安息香【主治病证】（1）闭证神昏（C对）。（2）心腹疼痛（B对）。（3）产后血晕（E对），痹痛日久（D对）。